角膜反射（以棉絮轻触角膜引起闭眼）消失可能是损伤了
A. 视神经
B. 动眼神经
C. 滑车神经
D. 面神经
E. 无

正确答案：D。面神经

解析：面神经（D对）控制眼轮匝肌的运动，参与角膜反射过程，受损后角膜反射消失。